白细胞吞噬微生物、肝脏单核吞噬细胞对有毒异物的消除方式
A. 简单扩散
B. 滤过
C. 胞饮
D. 易化扩散
E. 膜动转运

正确答案：E。膜动转运